男性，45岁，酗酒后8小时出现中上腹疼痛，放射至两侧腰部，伴恶心呕吐。体检腹部有压痛、肌紧张及两侧腰腹部出现蓝棕色斑，血压75/55mmHg，脉搏110次/分在诊断尚未确立之前，不应采用的是
A. 禁食胃肠减压
B. 吗啡类止痛药
C. 胰酶抑制剂
D. 体液补充
E. 营养支持

正确答案：B。吗啡类止痛药

解析：所有的急腹症在诊断明确前，禁用包含吗啡类（B错，为本题正确答案）在内的强效止痛剂，以免掩盖病情发展，延误诊断。禁食、胃肠减压（A对）可防止呕吐、减轻腹胀、降低腹内压。胰酶抑制剂（C对）可抑制胰腺组织的自我消化，减轻胰腺组织损伤。体液补充（D对）可弥补患者胃肠减压及腹腔渗出丢失的循环血量，有助于维持内环境的稳定。未明确诊断、不能进食的急腹症患者均应给予适当的营养支持，以维持机体基本生命活动所需（E对）。